目前认为与龋病关系最为密切的细菌是
A. 乳酸杆菌
B. 放线菌属
C. 血链球菌
D. 变形链球菌

正确答案：D。变形链球菌

解析：本题考查致龋微生物。目前认为与龋病关系最为密切的细菌是变形链球菌（D对）。变形链链球菌能较恒定地引起磨牙点隙沟裂龋、平滑面龋和根面龋，是目前认为与龋病关系最为密切的细菌。乳酸杆菌在动物实试验中具有致龋性，但次于变异链球菌，且仅能导致窝沟龋（A错）。放线菌属位于龈下菌斑内和牙根面，可引起根部龋和牙周组织破坏，与龋病关系不如变形链球菌密切（B错）。在动物和人类的有关研究中均已发现，血链球菌数量与龋病损害的出现呈负相关，目前尚无充分证据表明血链球菌是人类龋病的致龋菌（C错）。